主动脉瓣关闭不全，不可能出现的体征是
A. 毛细血管搏动征
B. 动脉瓣第二心音亢进
C. 主动脉瓣区可闻及叹气样舒张期杂音
D. 枪击音和杜氏双重杂音
E. 心浊音界呈靴形

正确答案：B。动脉瓣第二心音亢进

解析：动脉瓣第二心音亢进（B错，为本题正确答案）见于原发性肺动脉高压症、二尖瓣狭窄、左心衰竭、左至右分流的先天性心脏病、慢性肺源性心脏病等。主动脉瓣关闭不全时，可出现血管征如毛细血管搏动征（A对）、枪击音和杜氏双重杂音（D对）、主动脉瓣区可闻及叹气样舒张期杂音（C对）、心浊音界呈靴形（E对）。